去除龋坏所使用的中号挖匙，其直径为
A. 0.6mm
B. 1.5mm
C. 2.0mm
D. 2.5mm
E. 1.0mm

正确答案：B。1.5mm

解析：本题考查去除龋坏所使用的挖匙型号。去除龋坏所使用的中号挖匙，其直径为1.5mm（B对）。挖匙：去除软的腐质，清洁窝洞；一般分为3个号（D错）。直径0.6～1.0mm（AE错）为小号挖匙，直径2.0mm（C错）为大号挖匙。